不具有交感和副交感双重分布的器官有
A. 肾
B. 肾上腺髓质
C. 膀胱
D. 支气管
E. 心

正确答案：B。肾上腺髓质

解析：一般认为肾上腺髓质（B对）只接受交感神经支配。